根管治疗中器械折断于根管中未超过根尖孔，不易取出，可采用
A. 根尖切除术
B. 牙髓塑化疗法
C. 干尸术
D. 空管疗法
E. 复合树脂充填术

正确答案：B。牙髓塑化疗法

解析：本题考查牙髓塑化治疗的适应证。根管治疗中折断于根管中不易取出的器械未超过根尖孔，在严格消毒的情况下，器械对根尖区牙周组织损伤很小，器械不必取出。根管内由于存在折断器械，空间狭窄，采用常规根管充填方法不易获得足够的操作空间，可采用牙髓塑化疗法（B对），通过具有流动性渗透性和抑菌作用的塑化液可以严密充填根管系统，包裹折断的器械和牙髓坏死物，促进根尖周组织愈合防止复发。根尖切除术（A错）适用于根管治疗中折断器械超出根尖孔的情况，将超出根尖孔的器械切除防止其刺激根尖周，折断器械未超出根尖孔不会刺激根尖周组织不必行根尖切除术。干尸术（C错）又称干髓术，指先用失活剂将牙髓失活，除去冠髓，用干髓剂保存失活的根髓，使其保持无菌呈干尸状态，缺点是根管病原体去除不彻底，不能用于治疗根管中存在异物的患牙，否则会继发根尖炎症。空管疗法（D错）指覆盖在根管口的药物通过扩散和毛细血管作用对根管起到杀菌抑菌的作用，适用于年龄较大者后牙多根管的治疗，但治疗后不能有效封闭根管，根尖周组织液容易进入，造成再感染，不能用于治疗根管治疗中器械折断于根管中未超过根尖孔的患牙。复合树脂充填术（E错）用于治疗牙体缺损的修复治疗，不能治疗需要进行根管治疗的牙髓病或根尖周病。